患者，女，65岁，既往患有慢性肾衰竭。近日因劳累出现倦怠乏力，懒言，纳呆腹胀，便溏，腰膝酸软，舌淡有齿痕，苔白腻，脉沉细。其中医治法是
A. 和中降逆，化湿泄浊
B. 清化和中
C. 利水消肿
D. 补气健脾益肾
E. 活血化瘀

正确答案：D。补气健脾益肾

解析：患者既往慢性肾衰竭病史，因劳累出现倦怠乏力，懒言，为气虚表现，纳呆腹胀，便溏，为脾虚表现，后又出现腰膝酸软，为肾虚表现，又结合患者的舌苔脉象可判断患者属于慢性肾衰竭中医证型脾肾气虚证，故中医治法为补气健脾益肾（D对）。